关于《中国药典》收载内容的说法，错误的是
A. 正文中收载有药材饮片
B. 附录中收载有药品说明书
C. 正文中收载有药用辅料
D. 附录中收载有制剂通则
E. 附录中收载有炮制通则

正确答案：B。附录中收载有药品说明书

解析：本题考查的是《中国药典》收载内容。关于《中国药典》收载内容的说法，错误的是附录中收载有药品说明书（B错，为本题正确答案）。正文分为药材和饮片（A对）、植物油脂和提取物、成方制剂和单味制剂三部分。附录（包括制剂通则（D对）、通用检测方法和指导原则）按分类编码。索引分别按中文索引、汉语拼音索引、拉丁名索引和拉丁学名索引顺序排列。